慢性中央性颌骨骨髓炎病变比较局限者，死骨与周围组织分离的时间在发病后
A. 1～2周
B. 3～4周
C. 4～8周
D. 2个月以上
E. 半年以上

正确答案：B。3～4周

解析：慢性中央性颌骨骨髓炎病变比较局限者，死骨与周围组织分离的时间在发病后3～4周；如病变呈广泛弥漫者，则需5～6周或更长一段时间。一般应在死骨与周围骨质分离后，施行手术最好。死骨未分离，过早手术，有时不易确定死骨摘除的范围。掌握“颌骨骨髓炎”知识点。